皮肤依靠辐射传导和对流方式散热的主要途径
A. 皮肤血管扩张
B. 交感神经紧张性降低
C. 皮肤血流量减少
D. 皮肤散热减少
E. 小动脉舒张和动静脉吻合支开放

正确答案：E。小动脉舒张和动静脉吻合支开放

解析：机体通过辐射、传导和对流的散热方式散失热量的多少，主要取决于皮肤和环境之间的温度差，而皮肤温度的高低与皮肤的血流量有关。在炙热的环境中，通过降低交感神经紧张性，使小动脉舒张、动静脉吻合支开放（E对），皮肤血流量显著增多（C错），皮肤的散热增加（D错）。皮肤血管扩张（A错）只是其中的一个部分，交感神经紧张性降低（B错）只是过程中的一个步骤，都不是主要途径。